哌仑西平服后可能导致
A. 黑色大便
B. 口干和视力模糊
C. 便秘
D. 幻觉、定向力障碍
E. 疲乏、嗜睡

正确答案：B。口干和视力模糊